WHO积极推荐哪种指标用于儿童青少年的营养状况评价
A. 年龄别体重
B. 年龄别身高
C. 身高别体重
D. 身高体重指数
E. 体重指数

正确答案：C。身高别体重